采用吲哚美辛治疗动脉导管未闭的最佳年龄段是
A. 新生儿期
B. 学龄期
C. 青春期
D. 幼儿期
E. 学龄前期

正确答案：A。新生儿期

解析：动脉导管未闭是先心病中唯一可以用药物治愈的，但用药物吲哚美辛治疗受时间因素的影响，在生后新生儿期（生后1周内）治疗效果最好（A对）。